决明子除清肝明目外，又能
A. 疏散风热
B. 散结消肿
C. 润肠通便
D. 利尿通淋
E. 消肿排脓

正确答案：C。润肠通便

解析：本题考查的是决明子的功效。决明子除清肝明目外，又能润肠通便（C对）。决明子：【功效】清肝明目，润肠通便。谷精草：【功效】疏散风热（A错），明目退翳。夏枯草：【功效】清肝明目，散结消肿（B错）。鱼腥草：【功效】清热解毒，排脓消痈，利尿通淋（D错）。天花粉：【功效】清热生津，清肺润燥，消肿排脓（E错）。